革兰染色叙述错误的是
A. G+菌染成紫色
B. 染色顺序为结晶紫→95%乙醇→碘液→稀释复红
C. G-菌染成红色
D. 具有鉴别细菌意义
E. 具有指导选择抗菌药物的意义

正确答案：B。染色顺序为结晶紫→95%乙醇→碘液→稀释复红

解析：革兰染色法是常用的一种细菌染色法。染色步骤：①初染：第一液初染剂（结晶紫）染色1min，水洗。②媒染：第二液媒染剂（碘液）染色1min，水洗。③脱色：第二液脱色剂（95%乙醇）用到无紫色脱落为止，水洗。④复染：第四液复染剂（石碳酸或沙黄）染色30s，水洗，自然干燥后镜检。结果：革兰阳性呈紫色，革兰阴性呈红色。注意事项：①染色的结果受操作者的技术影响，尤其是容易过度脱色，往往阳性染成阴性。②在同一载玻片，需用已知金葡萄球菌及大肠埃希氏菌作革兰阳性及革兰阴性对照。③染色关键在于涂片，涂片不宜过厚，固定不宜过热，脱色不宜过度。④菌龄为18～24为佳。掌握“细菌的特殊结构及检查方法”知识点。